传染病爆发流行时，经省级政府决定对疫区实行封锁措施，此类传染病的类别和处理措施，属于
A. 甲类……紧急措施
B. 乙类……紧急措施
C. 甲类……特殊措施
D. 乙类……特殊措施
E. 乙类……一般措施

正确答案：A。甲类……紧急措施

解析：紧急措施是指当传染病暴发、流行时，县级以上地方人民政府应当立即组织力量，按照预防、控制预案进行防治，切断传染病的传播途径，必要时报经上一级人民政府决定。紧急措施包括（1）限制或者停止集市、剧院演出或者其他人群聚集的活动；（2）停工、停业、停课；（3）封闭或者封存被传染病病原体污染的公共饮用水源、食品以及相关物品；（4）控制或者扑杀染疫野生动物、家畜家禽；（5）封闭可能造成传染病扩散的场所。故题目中省级政府决定对疫区实行封锁措施属于紧急措施（CDE错）。省、自治区、直辖市人民政府可以决定对本行政区域内的甲类传染病疫区实施封锁（A对B错）；但是，封锁大、中城市的疫区或者封锁跨省、自治区、直辖市的疫区，以及封锁疫区导致中断干线交通或者封锁国境的，由国务院决定。